左心衰竭常见于
A. 冠心病
B. 肺动脉高压
C. 心肌炎
D. VitB1缺乏
E. 慢性肺炎

正确答案：A。冠心病

解析：冠心病（A对）时，心肌缺血缺氧，能量生成不足，使心肌收缩性降低，久之可造成左心衰。肺动脉高压（B错）时，肺循环阻力（右心室后负荷）增加，久之可因负荷过重超过心肌代偿能力而发生右心衰。心肌炎（C错）时，心肌细胞变性坏死，心肌收缩性降低，久之可导致全心衰。VitB1缺乏（D错）时，外周血管阻力降低，回心血量增加，左、右心室容量负荷增加，久之左、右心室失代偿，导致全心衰。